男性，9岁。胸骨左缘第2肋间听到连续性杂音，首先应考虑
A. 主动脉瓣狭窄
B. 肺动脉瓣狭窄
C. 室间隔缺损
D. 重度二尖瓣关闭不全
E. 动脉导管未闭

正确答案：E。动脉导管未闭

解析：患者为9岁儿童，胸骨左缘第2肋间听到连续性杂音（动脉导管未闭的典型杂音），首先应考虑动脉导管未闭（E对）。主动脉瓣狭窄（P296）（A错）的典型杂音为胸骨右缘1～2肋间粗糙而响亮的射流性杂音；肺动脉瓣狭窄（P275）（B错）的典型杂音为胸骨左缘第2肋间有一响亮的收缩期喷射样杂音（注意是收缩期杂音而不是连续性杂音）；室间隔缺损（P273）（C错）的典型杂音为胸骨左缘第3～4肋间可闻及Ⅳ～Ⅵ级全收缩期杂音；重度二尖瓣关闭不全（P292）（D错）的典型杂音为心尖部全收缩期吹风样杂音。